哪类龋病分类最适用于临床
A. 按发病情况分类
B. 按进展情况分类
C. 按损害解剖部位分类
D. 按病变深度分类
E. 其他分类

正确答案：D。按病变深度分类

解析：本题考查龋病的分类。根据病变深度分类（D对）的方法最适用于临床。龋病的分类：（1）按龋损深度分类：根据病变侵入深度可分为浅龋、中龋和深龋。这一分类方法在临床上最为适用。（2）按发病情况和进展速度分类：这种分类方法有利于对患者的整体情况综合考虑，有利于及时采取有针对的治疗和干预措施。（3）按龋病损害的解剖部位分类：龋病好发于窝沟、邻面、牙颈部等难以自洁的部位。根据牙齿解剖部位对龋病敏感性分类也是最常见和最简单的分类方法。（4）其他。